性别与真实性别不一致者为
A. 同性性早熟
B. 异性性早熟
C. 真性性早熟
D. 假性性早熟
E. 特发性性早熟

正确答案：B。异性性早熟

解析：按第二性征特征分类：早现的第二性征与患儿原性别相同时称为同性性早熟，与原性别相反时称为异性性早熟（B对A错）。中枢性性早熟又称真性性早熟，是由于儿童HPGA轴功能提前启动所致。下丘脑GnRH脉冲释放明显增强，垂体LH、FSH和卵巢、睾丸类固醇性激素浓度提前升高，配子开始形成，其发病机制复杂（C错）。其中原因不明者，称为特发性性早熟，又称为体质性性早熟，多见于女性。继发性性早熟则多见于中枢神经系统的异常（E错）。假性性早熟又称外周性性早熟，非受控于 HPGA轴，有第二性征的发育和性激素水平的升高，但是患儿的HPGA轴并未启动，反而受到体内存在的性激素的负反馈抑制，无性腺的发育（D错）。